Tm值是指
A. 不同的核酸链经变性处理，它们之间形成局部的双链
B. 标记一个已知序列核酸，通过杂交反应确定待测核酸是否含有相同的序列
C. 运输氨基酸
D. 单股DNA恢复成双股DNA
E. 50％双链DNA变性时的温度

正确答案：E。50％双链DNA变性时的温度

解析：本题考查DNA。DNA的变性发生在一定的温度范围内，这个温度范围的中点称为融解温度，用Tm表示。当温度达到融解温度时，DNA分子内50％的双螺旋结构被破坏（E对）。